下列各脏中，其生理特性以升为主的是
A. 肺与脾
B. 肺与肝
C. 肝与肾
D. 心与肾
E. 肝与脾

正确答案：E。肝与脾

解析：本题考查五脏的生理特性，属于理解记忆内容。脾气主升与肝的生理特性是主升主动表明生理特性以升为主的是肝与脾（E对）。心的主要生理功能是主血脉，主藏神，与生理特性以升为主无关（D错）。肺为五脏六腑之华盖，其气以清肃下降为顺。肾主纳气，是指肾气有摄纳肺所吸入的自然界清气，保持吸气的深度，防止呼吸表浅的作用，与生理特性以升为主相反（D错）。同时本题也是考察气的运动的基本形式：肝气、脾气主升，肺气、胃气主降。